抑制胃酸分泌作用最强的是
A. 西米替丁
B. 雷尼替丁
C. 奥美拉唑
D. 哌仑西平
E. 丙谷胺

正确答案：C。奥美拉唑

解析：奥美拉唑（omeprazole）有强大持久的抑制胃酸分泌作用。抑制胃酸作用持久，连续服用的效果优于单次服用。掌握“奥美拉唑”知识点。